细菌“核质以外的遗传物质”是指
A. mRNA
B. 核蛋白体
C. 质粒
D. 异染颗粒
E. 性菌毛

正确答案：C。质粒